某男，50岁。素患老痰胶结之咳喘，久治不愈；近5年又患癫痫，时有发作。宜选用的中药是
A. 瓦楞子
B. 海浮石
C. 海蛤壳
D. 昆布
E. 礞石

正确答案：E。礞石

解析：本题考查礞石的主治病证。宜选用的中药是礞石（E对）。礞石【主治病证】（1）顽痰、老痰胶结之气逆咳喘。（2）惊风抽搐，癫痫发狂。瓦楞子（A错）【主治病证】（1）顽痰久咳，瘰疬，瘿瘤。（2）癥瘕痞块。（3）胃痛泛酸。海浮石（B错）【主治病证】（1）肺热咳喘。（2）瘰疬结核。（3）淋证。海蛤壳（C错）【主治病证】（1）肺热、痰火咳喘。（2）瘿瘤，瘰疬，痰核。（3）水肿、小便不利。（4）胃痛泛酸。昆布（D错）【主治病证】（1）瘰疬，瘿瘤。（2）脚气浮肿，水肿，小便不利。